嗜酸性淋巴肉芽肿中的血管壁可呈现
A. 年轮样
B. 鱼鳞样
C. 波浪样
D. 洋葱皮样
E. 不规则样

正确答案：D。洋葱皮样

解析：嗜酸性淋巴肉芽肿的病损中可见血管壁增厚，甚至呈洋葱皮样外观。掌握“血管瘤及嗜酸性淋巴肉芽肿”知识点。